一男性患者，32岁，下颌后牙区近年来出现膨隆，并逐渐增大，致面部不对称，镜下检查可见纤维结缔组织囊壁内衬较薄的复层扁平上皮，仅由2～5列扁平细胞或矮立方细胞构成，无角化，没有上皮钉突。患者可诊断为
A. 含牙囊肿
B. 萌出囊肿
C. 根尖周囊肿
D. 非牙源性囊肿
E. 发育性根侧囊肿

正确答案：A。含牙囊肿

解析：含牙囊肿又称滤泡囊肿，多发生于10～39岁男性患者，下颌第三磨牙区最常见。囊肿生长缓慢，早期无自觉症状。较大时可引起颌骨膨隆或面部不对称、牙移位及邻近牙的根吸收；X线表现为圆形透射区，边界清楚，囊腔内可含一个未萌的牙冠。肉眼见囊壁较薄，囊腔内含有牙冠，囊壁附着于牙颈部，囊液多呈黄色；镜下见纤维结缔组织囊壁内衬较薄的复层扁平上皮，仅由2～5列扁平细胞或矮立方细胞构成，无角化，没有上皮钉突，类似于缩余釉上皮；纤维囊壁内炎症不明显。囊肿继发感染时，上皮增生，上皮钉突明显，囊壁组织内见大量炎症细胞浸润；约40%囊肿的衬里上皮可发生黏液化生，含产黏液细胞或纤毛柱状细胞，少数情况还可见皮脂腺细胞；某些病例的衬里上皮还可发生区域性角化，一般为正角化；纤维囊壁中有时可见牙源性上皮岛。掌握“牙源性囊肿”知识点。